有关鼓膜的叙述正确的是
A. 是外耳道与鼓室之间的椭圆形半透明薄膜
B. 呈向前、向下、向外的位置，与矢状面和水平面各成40°角
C. 前上部较小为松弛部，下部较大为紧张部
D. 凸面对向中耳，中心为鼓膜脐
E. 又称许莱姆(Schlemm)管

正确答案：A。是外耳道与鼓室之间的椭圆形半透明薄膜

解析：鼓膜位于外耳道与鼓室之间，为椭圆形半透明薄膜（A对），直径约 1cm, 与外耳道底形成约 45°~ 50° 的倾斜角（B错）。鼓膜上1/4 的三角形区，称为松弛部，下3/4 区，为紧张部（C对）。鼓膜边缘的大部分附着于颞骨上，中心向内凹陷（D错），称鼓膜脐。